有清胆利湿，和胃化痰功用的方剂是
A. 茵陈蒿汤
B. 青蒿鳖甲汤
C. 半夏泻心汤
D. 四逆散
E. 蒿芩清胆汤

正确答案：E。蒿芩清胆汤

解析：蒿芩清胆汤方含青蒿脑（青蒿新发之嫩芽）、黄芩，可清胆热、燥湿；竹茹、半夏，可和胃、化痰；枳壳、陈皮，可理气、化痰；赤茯苓、碧玉散（滑石、甘草、青黛），可清热利湿，共奏清胆利湿、和胃、化痰（E对），主治少阳湿热痰浊证。茵陈蒿汤的功用为清热利湿退黄（A错）。青蒿鳖甲汤的功用为养阴透热（B错）。半夏泻心汤的功用为寒热平调，散结除痞（C错）。四逆散的功用为透邪解郁，疏肝理脾（D错）。